下列组织切开的相关描述中，不恰当的一项是
A. 深层组织以及黏膜可直接用电刀或光刀切割
B. 肿瘤手术多采用电刀，也可用光刀
C. 使用电刀时，刀尖移动速度宜稍慢，否则达不到止血效果
D. 面部整复手术最常用的是电刀，不用钢刀
E. 手术中如更换刀片，一般采用持针器夹持刀片完成更换

正确答案：D。面部整复手术最常用的是电刀，不用钢刀

解析：肿瘤手术多采用电刀，也可用光刀。使用电刀或光刀切开时，皮肤层仍宜先用钢刀切开，以减少愈合后形成明显瘢痕。深层组织以及黏膜可直接用电刀或光刀切割。使用电刀时，刀尖移动速度宜稍慢，否则达不到止血效果。面部整复手术一般使用钢刀而不使用电刀或光刀切割组织。手术中如更换刀片，一般采用持针器夹持刀片完成更换。注意夹持不可放松，用力不可过猛。掌握“口外手术组织切开、止血及组织分离”知识点。